十二指肠悬肌附于
A. 十二指肠球部
B. 十二指肠升部
C. 十二指肠降部
D. 十二指肠水平部
E. 十二指肠空肠曲

正确答案：E。十二指肠空肠曲

解析：十二指肠悬肌附着于十二指肠空肠曲(E对)与右膈脚上。